对颅内压增高的患者，不适宜的处理是
A. 必要时行颅内压监测
B. 频繁呕吐者予输液维持水、电解质平衡
C. 意识不清者应维持其呼吸道通畅
D. 留院观察
E. 便秘者行灌肠

正确答案：E。便秘者行灌肠

解析：凡有颅内压增高的病人，应留院观察（D对），必要时行颅内压监测（A对），频繁呕吐者予输液维持水、电解质平衡（B对），意识不清者应维持其呼吸道通畅（C对），防止因呼吸不畅而使颅内压更加增高。便秘者行灌肠可致颅内压骤然升高（E错，为本题正确答案），应使用轻泻剂。